下列属于正细胞性贫血的是
A. 急性失血性贫血
B. 骨髓增生异常综合征
C. 缺铁性贫血
D. 慢性失血性贫血
E. 铁粒幼细胞贫血

正确答案：A。急性失血性贫血